中国人急性胰腺炎最常见的病因
A. 药物
B. 病毒感染
C. 酒精
D. 胆道系统疾病
E. 自身免疫

正确答案：D。胆道系统疾病

解析：急性胰腺炎有多种致病危险因素，国内以胆道疾病为主，占50%以上，称胆源性胰腺炎。故胆道系统疾病是中国人急性胰腺炎最常见的病因（D对）。药物（噻嗪类利尿剂、硫唑嘌呤、糖皮质激素、磺胺类等）、病毒感染（急性流行性腮腺炎、甲型流感、肺炎衣原体感染、传染性单核细胞增多症、柯萨奇病毒感染等）、酒精（促进胰液分泌，当胰管流出道不能充分引流大量胰液时，胰管内压升高，引发腺泡细胞损伤）、自身免疫（影响胰腺血供）也可导致急性胰腺炎，但不是最常见的病因（ABCE错）。